在治疗沙眼的非处方药中，具有较强抑制沙眼衣原体作用的药品是
A. 硫酸锌
B. 磺胺醋酰钠
C. 酞丁安
D. 可的松
E. 酮康唑

正确答案：C。酞丁安

解析：本题考查沙眼治疗药。在治疗沙眼的非处方药中，具有较强抑制沙眼衣原体作用的药品是酞丁安（C对）。酞丁安可以在沙眼包涵体未形成时，阻止沙眼衣原体繁殖和包涵体的形成，具有较强的抑制沙眼衣原体的作用，对沙眼有很好的疗效。硫酸锌（A错）在低浓度时呈收敛作用，锌离子能沉淀蛋白，可与眼球表面和坏死组织及分泌物中的蛋白质形成极薄的蛋白膜，起到保护作用；高浓度时有杀菌和凝固作用，有利于创面及溃疡的愈合。磺胺醋酰钠（B错）在结构上为一种类似对氨基苯甲酸（PABA）的物质，可竞争抑制二氢叶酸合成酶，从而阻止细菌的生长、繁殖。可的松（D错）属于肾上腺糖皮质激素，酮康唑（E错）属于抗真菌药，两者不用于沙眼的治疗。